下列喉肌中，何者不能缩小声门裂
A. 环杓侧肌
B. 环杓后肌
C. 杓横肌
D. 杓斜肌
E. 甲杓肌

正确答案：B。环杓后肌

解析：环杓后肌（B对）的主要作用是开大声门裂。